某医疗机构1周内收治多名患手足口病的小学生，未按规定履行报告职责，也未及时采取控制措施，致使疫情扩散。县卫生行政部门得知此情况后立即启动应急预案，及时控制了疫情，同时对事件进行调查，认为该医疗机构行为违法且情节严重，依法做出处理。该处理是
A. 责令改正
B. 通报批评
C. 吊销《医疗机构执业许可证》
D. 给予警告
E. 暂停执业活动

正确答案：C。吊销《医疗机构执业许可证》

解析：该医疗机构的的违法行为主要包括了未按规定履行报告职责和未及时采取控制措施，致使疫情扩散，经认定情节严重，应给予吊销《医疗机构执业许可证》（C对），若为认定情节较轻的话，给予责令改正（A错）、通报批评（B错）、给予警告（D错），而暂停执业活动（E错）的处理多用于发生医疗事故的相关医务人员、在执业活动中违反规定的医师及考核不合格的医师。